男，45岁。行脊柱肿瘤切除术，术中给予输血，输注悬浮红细胞15分钟后，血压下降到70/40mmHg，导尿管中的尿液呈酱油
A. 细菌污染反应
B. 输血相关急性肺损伤
C. 急性溶血性输血反应
D. 输血相关循环超负荷
E. 严重过敏反应

正确答案：C。急性溶血性输血反应

解析：中年男性患者，行脊柱肿瘤切除术，术中给予输血，输注悬浮红细胞15分钟后，血压下降到70/40mmHg（＜90/60mmHg，休克），导尿管中的尿液呈酱油色，综合患者的症状、体征，初步诊断为急性溶血性输血反应（C对）。细菌污染反应（A错）表现为烦躁、寒战、高热、呼吸困难、恶心、呕吐、发绀、腹痛。输血相关急性肺损伤（B错）为供血者血浆中存在白细胞凝集素或HLA特异性抗体所致，表现为急性呼吸困难、严重的双侧肺水肿及低氧血症，可伴有发热和低血压，后者对输液无效。输血相关循环超负荷（D错）常见于心功能低下、老年、幼儿及低蛋白血症病人，由输血速度过快、过量引起，表现为输血中或输血后突发心率加快、呼吸急促、发绀或咳吐血性泡沫痰，有颈静脉怒张、静脉压升高，肺内可闻及大量湿啰音，胸片可见肺水肿表现。严重过敏反应（E错）表现为皮肤局限性或全身性瘙痒或荨麻疹。严重者可出现支气管痉挛、血管神经性水肿、会厌水肿，表现为咳嗽、喘鸣、呼吸困难以及腹痛、腹泻，甚至过敏性休克乃至昏迷、死亡。